药物的内在活性（效应力）是指
A. 药物穿透生物膜的能力
B. 药物激动受体的能力
C. 药物水溶性大小
D. 药物对受体亲和力高低
E. 药物脂溶性强弱

正确答案：B。药物激动受体的能力

解析：本题考查药物的内在活性。药物的内在活性（效应力）是指药物激动受体的能力（B对）。内在活性是指药物与受体结合后产生效应的能力。内在活性大的药物只需要占领少部分受体，即可产生最大效应，并不需要占领全部受体。药物穿透生物膜的能力（A错）、药物水溶性大小（C错）、药物脂溶性强弱（E错）是影响药物吸收和分布的因素，与药物内在活性无关。药物对受体亲和力高低（D错）是药物的亲和力，即药物与受体结合的能力。